医学道德保密的作用最核心的是
A. 体现了患者对医务人员的无比信任
B. 体现了医务人员对病人人格和权利的尊重
C. 有利于保护医务人员个人的权利
D. 有利于医护工作的开展和医护质量的提高
E. 可以避免因泄密而给病人带来危害和发生医患纠纷

正确答案：B。体现了医务人员对病人人格和权利的尊重

解析：医学道德保密的作用最核心的是体现了医务人员对病人人格和权利的尊重。医学道德保密的作用体现了患者对医务人员的无比信任、有利于保护医务人员个人的权利、有利于医护工作的开展和医护质量的提高、可以避免因泄密而给病人带来危害和发生医患纠纷，这些是医学道德保密的作用，但不是最核心的（B对）。